麝香中具特异强烈香气的活性成分主要是
A. 雄甾酮
B. 麝香酮
C. 麝香吡啶
D. 麝香酯
E. 尿囊素

正确答案：B。麝香酮

解析：本题考查的是麝香的成分。麝香中具特异强烈香气的活性成分主要是麝香酮（B对）。麝香【成分】含大环酮类化合物：主为麝香酮，含量0.93%～4.12%，具特异强烈香气，为主要活性成分。另含少量降麝香酮，3-甲基环十三酮，环十四酮等。生物碱类化合物：麝香吡啶（C错），羟基麝香吡啶A，羟基麝香吡啶B等。甾体化合物：总雄性激素0.24%～0.94%，如雄甾酮（A错）、表雄甾酮等多种雄甾烷衍生物。此外，尚含脂肪酸、胆甾醇、麝香酯（D错）、尿囊素（E错）、尿素和无机成分（硫酸盐、磷酸盐和碳酸盐等）。